被称为“元神之府”的是
A. 脑
B. 髓
C. 骨
D. 脉
E. 胆

正确答案：A。脑

解析：脑为神明之所出，故称“脑为元神之府”（A对）。骨为髓之府（BC错）。脉为血之府（D错）。胆为中精之府（E错）